某人去市场买鱼，发现鱼鳞脱落，鳃呈褐色，并闻到有恶臭气味。引起鱼发生这种变化的主要原因是微生物分解了
A. 蛋白质
B. 脂肪
C. 单糖
D. 膳食纤维
E. 水

正确答案：A。蛋白质

解析：本题考查食品中蛋白质的分解。鱼富含蛋白质，其腐败变质的主要原因是微生物分解了蛋白质（A对BCDE错），从而产生恶臭气味。